下列氨基酸中能转化生成儿茶酚胺的是
A. 天冬氨酸
B. 色氨酸
C. 酪氨酸
D. 脯氨酸
E. 蛋氨酸

正确答案：C。酪氨酸

解析：儿茶酚胺包括多巴胺、去甲肾上腺素及肾上腺素。酪氨酸（C对）转变为儿茶酚胺和黑色素或彻底氧化分解。天冬氨酸（A错）参与合成嘌呤碱和嘧啶碱。色氨酸（B错）参与合成5-羟色胺。脯氨酸（P16）（D错）在维系蛋白质二级结构如β-转角结构上起到了重要作用。蛋氨酸（E错）即甲硫氨酸参与合成肌酸、磷酸肌酸等。